曲池在五输穴中，属
A. 井穴
B. 荥穴
C. 合穴
D. 经穴
E. 输穴

正确答案：C。合穴

解析：该题考查五输穴。曲池为手阳明大肠经的腧穴，手阳明大肠经的五输穴井、荥、输、经、合穴分别为商阳、二间、三间、阳溪、曲池（C对ABDE错）。